补肾养肝的理论依据是
A. 五行相侮
B. 五行相乘
C. 五行相克
D. 五行相生
E. 五行制化

正确答案：D。五行相生

解析：本题考查的是五行的生克乘侮。补肾养肝的理论依据是五行相生（D对）。肾与水对应、肝与木对应，水生木，故补肾养肝的理论依据是五行相生。五行的生克乘侮：（一）五行的相生相克：1.五行相生：五行相生，是指木、火、土、金、水之间存在着有序的资生、助长和促进的作用。五行相生的次序是：木生火，火生土，土生金，金生水，水生木。2.五行相克（C错）：五行相克，是指木、土、水、火、金之间存在着有序的克制、制约的作用。五行相克的次序是：木克土，土克水，水克火，火克金，金克木。（二）五行的相乘相侮：1.五行相乘（B错）：五行相乘，是指五行的某一行对所胜一行克制太过，从而引起一系列的异常相克反应，也称为“过克”。2.五行相侮（A错）：五行相侮，是指由于五行的某一行对所不胜一行进行反向克制，又称“反侮”或“反克”。五行制化（E错），2022年考试指南未明确说明。